一般器械、布类、纱布、棉花类及橡胶类等均可使用的消毒方法是
A. 高压蒸汽灭菌
B. 煮沸消毒法
C. 干热灭菌法
D. 化学消毒法
E. 紫外线消毒

正确答案：A。高压蒸汽灭菌

解析：高压蒸气灭菌：一般器械、布类、纱布、棉花类及橡胶类等均可使用。灭菌效果可靠，但不同物质的压力和灭菌时间要求不同。掌握“口外消毒和灭菌”知识点。